某男，35岁。患痰热阻肺，症见咳嗽痰多、痰黄黏稠、胸腹满闷。宜选用的成药是
A. 复方鲜竹沥液
B. 半夏天麻丸
C. 清气化痰丸
D. 蛇胆川贝散
E. 蜜炼川贝枇杷膏

正确答案：C。清气化痰丸

解析：本题考查的是清气化痰丸的主治。患痰热阻肺，症见咳嗽痰多、痰黄黏稠、胸腹满闷。宜选用的成药是清气化痰丸（C对）。清气化痰丸：【主治】痰热阻肺所致的咳嗽痰多、痰黄黏稠、胸腹满闷。复方鲜竹沥液（A错）：【主治】痰热咳嗽，痰黄黏稠。半夏天麻丸（B错）：【主治】脾虚湿盛、痰浊内阻所致的眩晕、头痛、如蒙如裹、胸脘满闷。蛇胆川贝散（D错）：【主治】肺热咳嗽，痰多。蜜炼川贝枇杷膏（E错）：【主治】肺燥咳嗽，痰黄而黏，胸闷，咽喉疼痛或痒，声音嘶哑。